关于氢氯噻嗪说法错误的是
A. 氢氯噻嗪在碱性溶液中易水解失活，一般不与碱性药物配伍
B. 氢氯噻嗪可与盐酸成盐
C. 氢氯噻嗪常与降压药合用，可用于治疗轻、中度高血压
D. 氢氯噻嗪可与氨苯蝶啶合用增强利尿作用
E. 氢氯噻嗪大剂量长期使用，应与KCl同服，避免血钾过低

正确答案：B。氢氯噻嗪可与盐酸成盐

解析：本题考查氢氯噻嗪的性质。氢氯噻嗪不与盐酸反应（B错，为本题正确答案），会在碱性溶液中水解生成二磺酰胺中间体和甲醛，易水解失活。氢氯噻嗪常与其他降压药合用，以增强疗效；对轻、中度高血压，单独使用即可有效；大剂量或长期使用时，应与氯化钾同服，以避免血钾过低。